在肠壁吸收后可代谢生成喷昔洛韦的前体药物是
A. 更昔洛韦
B. 盐酸伐昔洛韦
C. 阿昔洛韦
D. 泛昔洛韦
E. 阿德福韦酯

正确答案：D。泛昔洛韦

解析：本题考查喷昔洛韦的前体药物。泛昔洛韦（D对）口服后在肠壁吸收后被代谢为喷昔洛韦。阿昔洛韦（C错）、更昔洛韦（A错）是开环嘌呤核苷类似物的抗病毒药。盐酸伐昔洛韦（B错）是阿昔洛韦的前体药。阿德福韦酯（E错）是阿德福韦的前体药物。